男，18岁。急起四肢无力，进行性加重。病前有腹泻病史。查体：四肢肌力3级。最可能诊断是
A. 脊髓灰质炎
B. 周期性瘫痪
C. 中毒性神经炎
D. 卟啉病
E. 吉兰-巴雷综合征

正确答案：E。吉兰-巴雷综合征

解析：患者青年男性，急起四肢无力，进行性加重，病前有腹泻病史，查体四肢肌力3级，根据病史特点，应诊断为吉兰-巴雷综合征（E对）的急性运动轴索性神经病（AMAN）。脊髓灰质炎（A错）又称小儿麻痹，是由脊髓灰质炎病毒引起的一种急性传染病，会有发热、头痛、呕吐等全身不适症状，后期会有肢体麻痹和瘫痪。周期性瘫痪（B错）多在寒冷、疲劳等诱因下，在睡眠中或晨起后发现四肢软瘫、麻木、酸痛、无力。中毒性神经炎（C错）表现为四肢对称性手套、袜套样深浅感觉障碍，伴四肢远端肌力减退，跟腱反射减退或消失，严重者出现肌萎缩。卟啉病（D错）表现为光敏性皮炎、腹痛和神经精神障碍。